患者，女，33岁，已婚。孕3堕3。头晕目眩，神疲乏力，心悸气短，舌质淡，苔薄白，脉细弱。治疗应首选
A. 泰山磐石丸
B. 寿胎丸
C. 肾气丸
D. 安奠二天汤
E. 补肾固冲丸

正确答案：A。泰山磐石丸

解析：该患者孕3堕3，故诊断为滑胎。气血两虚，冲任不足，不能载胎养胎，故屡孕屡堕；气血虚弱，不能濡养清窍则头晕目眩，外不能濡润肌肤，内不能濡养脏腑，故神疲乏力，心悸气短；舌质淡，苔薄白，脉细弱均为气血虚弱之象，故辨为气血虚弱证。治宜益气养血，固冲安胎，方选泰山磐石散（A对）。寿胎丸常合桂枝茯苓丸治疗滑胎血瘀证，功能补肾安胎（B错）。肾气丸为滑胎肾虚证偏肾阳亏虚的选方，功能温补肾阳，固冲安胎（C错）。安奠二天汤为滑胎脾肾虚弱证的选方，功能补肾健脾，养血安胎（D错）。补肾固冲丸为治疗滑胎肾虚证偏肾气不足的选方，功能补肾健脾，固冲安胎（E错）。